产前诊断胎儿畸形最常用的手段是
A. 胎儿心电图
B. 羊膜腔穿刺羊水检查
C. 胎儿头皮血PH值检查
D. 羊膜镜检查
E. B超检查

正确答案：E。B超检查

解析：B型超声（E对）是目前使用最广泛的胎儿影像学监护仪器，可以观察胎儿大小（包括胎头双顶径、腹围、股骨长）、胎动及羊水情况；还可以进行胎儿畸形筛查。胎儿心电图（A错）检查是通过监护胎心的活动情况来反映胎儿在子宫内的存活情况之一。羊膜腔穿刺羊水检查（P433）（B错）可获取胎儿细胞和染色体，可用来诊断染色体疾病，但因其有可能引起感染等潜在危险，并不是最常用来诊断胎儿畸形的手段。胎儿头皮血pH值检查（P119）（C错）可判断胎儿是否有宫内窘迫等宫内安危情况。羊膜镜（D错）是通过观察妊娠期或分娩期羊水情况，判断胎儿安危的手段。